医学科研的灵魂和科研人员的良心是什么？
A. 同情
B. 公正
C. 廉洁
D. 诚实
E. 勤奋

正确答案：D。诚实

解析：科研诚信定义为：科技人员在科技活动中弘扬以追求真理、实事求是、崇尚创新、开放协作为核心的科学精神（D对ABCE错）。